有关脊髓的描述,正确的是
A. 成人从枕骨大孔延伸到第2腰椎下缘
B. 在胸段大部分有侧角
C. 有31个节段
D. 背侧有一条深的后正中裂
E. 在新生儿下端平齐第1腰椎下缘

正确答案：C。有31个节段

解析：脊髓在成人中从枕骨大孔延伸到第1腰椎下缘（A错），新生儿可达第3腰椎下缘（E错）。脊髓可分为31个节段（C对）：即颈髓(C)8个节段、胸髓(T)12个节段、腰髓(L)5个节段、骶髓(S)S5个节段和尾髓(Co)1个节段。脊髓背侧正中较浅的沟为后正中沟（D错）。在胸髓和上腰髓(T1-L3),中间带外侧部向外伸出侧角（B错）。